男性，4岁。诉发音不清求治。口腔检查：舌不能自由前伸，伸舌时舌尖部呈“M”形，智力发育正常。引起发音不清的可能原因是
A. 智力发育迟缓
B. 舌系带过短
C. 有心理障碍
D. 发音教育不明确
E. 地方方言过重

正确答案：B。舌系带过短

解析：本题考查引起发音不清的原因。舌系带过短（B对）会引起舌运动困难，而在发音过程中舌起着重要作用，结合患者其他症状，引起发音不清的可能原因是舌系带过短。题干中提及该患儿智力发育正常，因此智力发育迟缓（A错）不会是引起发音不清的原因。心理障碍（C错）除发音不清外，还会有其他行为上的异常表现，如哭闹、叛逆、吵闹等，根据该患儿其他症状，应排除心理障碍。若只是发音教育不明确（D错），口腔检查时伸舌时舌尖部不会呈“M”形。地方方言过重（E错）只是语言本身的问题，不会致患儿发音不清。